引起“肠源性紫绀”的原因是
A. 一氧化碳中毒
B. 亚硝酸盐中毒
C. 氰化物中毒
D. 肠系膜血管痉挛
E. 肠道粘膜水肿

正确答案：B。亚硝酸盐中毒

解析：肠源性紫绀是指食用大量含硝酸盐的腌菜等食物后出现亚硝酸盐中毒（B对），硝酸盐经肠道细菌作用还原为亚硝酸盐，吸收入血后使大量血红蛋白被氧化，形成高铁血红蛋白血症，皮肤、黏膜出现青紫色。一氧化碳中毒（A错）、氰化物中毒（C错）、肠系膜血管痉挛（D错）、肠道粘膜水肿（E错）都不是引起“肠源性紫绀”的原因。